对准备结婚的男女双方进行婚前医学检查，主要是检查
A. 可能患影响结婚和传染配偶的疾病
B. 可能患影响结婚和生育的疾病
C. 可能患影响分娩和生育的疾病
D. 可能患影响结婚和健康的疾病
E. 可能患影响生活和生育的疾病

正确答案：B。可能患影响结婚和生育的疾病

解析：本题考查婚前医学检查的相关内容。婚前医学检查是对准备结婚的男女双方是否患有可能影响结婚和生育的疾病（B对ACDE错）所进行的医学检查，包括病史询问、体格检查及相关医技检查。